牙齿行盖髓术2周后，牙髓活力正常，则可以进行
A. 牙髓失活
B. 暂封
C. 永久充填
D. 开放
E. 拔除

正确答案：C。永久充填

解析：本题考查盖髓术。盖髄术后2周，如果无任何症状，且牙髓活力正常者，则除去大部分暂封剂，垫底后作永久充填（C对）。